根据《中华人民共和国广告法》，可做广告的药品是
A. 哌替啶
B. 美沙酮
C. 苯丙胺
D. 三唑仑
E. 麻仁丸

正确答案：E。麻仁丸

解析：本题考查不得发布广告的产品。根据《中华人民共和国广告法》，可做广告的药品是麻仁丸是中成药，属于非处方药，用于润肠通便，可以做广告（E对）。不得发布广告的产品：按照规定，不得做广告的产品包括：①麻醉药品（AB错）、精神药品（CD错）、医疗用毒性药品、放射性药品、药品类易制毒化学品，以及戒毒治疗的药品、医疗器械；②军队特需药品、军队医疗机构配制的制剂；③医疗机构配制的制剂；④依法停止或者禁止生产、销售或者使用的药品、医疗器械、保健食品和特殊医学用途配方食品；⑤法律、行政法规禁止发布广告的情形。